下列关于四环素的正确叙述有
A. 是抑制细菌蛋白质合成的广谱抗生素
B. 对绿脓杆菌和真菌有效
C. 对革兰阳性菌作用不如青霉素和头孢菌素
D. 对革兰阴性菌作用不如链霉素和氯霉素
E. 妊娠5个月以上的孕妇、哺乳期妇女禁用

正确答案：A、C、D、E。是抑制细菌蛋白质合成的广谱抗生素；对革兰阳性菌作用不如青霉素和头孢菌素；对革兰阴性菌作用不如链霉素和氯霉素；妊娠5个月以上的孕妇、哺乳期妇女禁用